主要成分为去氧胆酸的中药是
A. 龙胆
B. 蟾酥
C. 牛黄
D. 大黄
E. 薄荷

正确答案：C。牛黄

解析：本题考查的是牛黄的化学成分。主要成分为去氧胆酸的中药是牛黄（C对）。牛黄约含8%胆汁酸，主要成分为胆酸、去氧胆酸和石胆酸。此外，还含有7%SMC及胆红素，胆固醇，麦角固醇，多种氨基酸（如丙氨酸、甘氨酸、牛磺酸、精氨酸、天冬氨酸、蛋氨酸等）和无机盐等。《中国药典》以胆酸和胆红素为牛黄的质量控制成分，要求胆酸含量不少于4.0%，胆红素含量不得少于25.0%。龙胆（A错）含有的主要有效成分为裂环环烯醚萜苷类化合物，如獐牙菜苷、獐牙菜苦苷和龙胆苦苷等。此外还含有生物碱、黄酮、香豆素及内酯等化合物。《中国药典》以龙胆苦苷为指标成分进行含量测定，龙胆中含量不得少于3.0%；坚龙胆中含量不得少于1.5%。蟾酥（B错）的化学成分复杂，主要成分有蟾蜍甾二烯类、强心甾烯蟾毒类、吲哚碱类、甾醇类以及肾上腺素、多糖、蛋白质、氨基酸和有机酸等，前两类成分具有强心作用。《中国药典》以蟾毒灵、华蟾酥毒基和脂蟾毒配基为指标成分进行含量测定，要求总量不得少于7.0%。大黄（D错）中的主要蒽醌类成分及其化学结构：从大黄中分离得到蒽醌、二蒽酮、芪、苯丁酮、单宁、萘色酮等不同种类的80多种化合物，大体上可分为蒽醌类、多糖类与鞣质类。其中蒽醌类及其衍生物含量为3%～5%，分为游离型与结合型。《中国药典》以总蒽醌和游离蒽醌为指标成分，采用高效液相色谱法测定药材和饮片中芦荟大黄素、大黄酸、大黄素、大黄酚和大黄素甲醚等总蒽醌的含量，要求药材总蒽醌不得少于1.5%，游离蒽醌不得少于0.20%。薄荷（E错）挥发油的化学组成很复杂，油中成分主要是单萜类及其含氧衍生物。薄荷油的质量优劣主要依据其中薄荷醇（薄荷脑）含量的高低而定，《中国药典》以挥发油作为质量控制指标之一，要求其含量不得少于0.8%（ml/g）。同时规定，薄荷脑也作为指标成分，采用气相色谱法测定，含量不得少于0.20%。